下列各项，不属于慢性支气管炎中医病因的是
A. 外邪侵袭
B. 肺脏虚弱
C. 肝气郁结
D. 脾虚生痰
E. 肾气虚衰

正确答案：C。肝气郁结

解析：外邪侵袭（A对），肺卫失宣，引起咳嗽，气喘，发为慢性支气管炎；肺脏虚弱（B对），卫表不固，易致外邪侵袭、脾虚生痰（D对），阻碍肺气宣降，故见咳嗽、喘憋，发为慢性支气管炎；肾气虚衰（E对），不能纳气，则易见气短等症状，发为慢性支气管炎。其病位在肺，涉及脾肾，不包含肝气郁结（C错，为本题正确答案）。